发为痈肿疮疡的邪气是
A. 风
B. 湿
C. 寒
D. 火
E. 燥

正确答案：D。火

解析：本题考查外感六淫的致病特点，属于理解记忆内容。火邪入于血分，可聚于局部，腐蚀血肉，发为痈肿疮疡，热胜肉腐，肉腐成脓，这就是痈。（D对，ABCE错）。